能够降低药物的溶解度，达到缓释目的的包合材料是
A. 葡糖基-β-CD
B. 乙基-β-CD
C. α-CD
D. γ-CD
E. β-CD

正确答案：B。乙基-β-CD